某男，6岁。因外感风寒、肺胃蕴热导致发热恶寒、鼻塞流涕、咳嗽有痰、咽喉肿痛、口渴，儿科医师处以儿感清口服液。此因该成药除解表清热外又能
A. 宣肺化痰
B. 化痰利咽
C. 解毒止痛
D. 宣肺平喘
E. 泻火利咽

正确答案：A。宣肺化痰

解析：本题考查的是儿感清口服液的功能。某男，6岁。因外感风寒、肺胃蕴热导致发热恶寒、鼻塞流涕、咳嗽有痰、咽喉肿痛、口渴，儿科医师处以儿感清口服液。此因该成药除解表清热外又能宣肺化痰（A对）。儿感清口服液：【功能】解表清热，宣肺化痰。黄氏响声丸：【功能】疏风清热，化痰散结，利咽（B错）开音。小儿咽扁颗粒：【功能】清热利咽，解毒止痛（C错）。小儿咳喘灵颗粒：【功能】宣肺清热，止咳祛痰，平喘（D错）。小儿热速清口服液：【功能】清热解毒，泻火利咽（E错）。